欲研究A、B两种方法测定同一批新生儿脐动脉血微量元素含量是否不同，收集了32例经产道自然分娩的足月新生儿，测得其脐动脉血中锌的含量。下列说法中正确的是
A. 只能选用成组t检验
B. 只能选用配对t检验
C. 只能选用完全随机设计资料的方差分析
D. 只能选用配伍组设计资料的方差分析
E. 可选用配对t检验或配伍组设计资料的方差分析

正确答案：E。可选用配对t检验或配伍组设计资料的方差分析